患者头痛以前额为甚，面赤而红，牙痛，便干，舌红苔黄，脉弦。处方用药加用白芷，除治疗效应外，其引经报使作用在
A. 少阳经
B. 太阳经
C. 阳明经
D. 少阴经
E. 厥阴经

正确答案：C。阳明经

解析：少阳头痛多在两侧，并连及耳部，多选用柴胡，黄芩，川芎（A错）。太阳头痛多在头后部，下连于项，常选用羌活，蔓荆子，川芎（B错）。题中患者头痛的部位为前额，故为阳明经头痛，且白芷为治疗阳明头痛的引经药，故（C对）。少阴头痛多以全头痛多见，常选用细辛（D错）。厥阴头痛多在巅顶部，或连于目系，常选用藁本，吴茱萸等（E错）。